男，30岁。反酸、烧心2个月。无吞咽困难，大便正常。查体：无贫血貌，腹部查体未见异常。予奥美拉唑治疗，应用该药的目的是
A. 通过抑制胃泌素分泌，抑制胃酸分泌
B. 通过括抗胆碱受体，抑制胃酸分泌
C. 中和胃酸，提高胃内PH值
D. 通过拮抗H2受体，抑制胃酸分泌
E. 通过抑制H⁺-K⁺-ATP酶，抑制胃酸分泌

正确答案：E。通过抑制H⁺-K⁺-ATP酶，抑制胃酸分泌

解析：中年男性患者，反酸、烧心（胃食管反流病的典型症状），因此最可能诊断为胃食管反流病（GERD）。抑酸药PPI（如奥美拉唑）是治疗GERD的首选药物。PPI称为质子泵抑制剂，PPI入血，进入到胃黏膜壁细胞酸分泌小管中，酸性环境下转化为活性结构，与质子泵即H⁺-K⁺-ATP酶结合，抑制该酶的活性、从而抑制胃酸的分泌（E对）。中和胃酸，提高胃内PH值（C错）的是弱碱性抗酸剂（P362）。通过拮抗H2受体，抑制胃酸分泌（D错）（P348）的是组胺H2受体拮抗剂（H₂RA）。